旋覆代赭汤的功用不包括
A. 益气
B. 降逆
C. 和胃
D. 止咳
E. 化痰

正确答案：D。止咳

解析：本题考查旋覆代赭汤的功用，属记忆内容。旋覆代赭汤功用降逆化痰，益气和胃，止咳不是旋覆代赭汤的功用（D对）。